下列各项中，不属于月经后期气滞血瘀证的临床表现是
A. 月经量少或正常
B. 经色黯红或有小血块
C. 胸胁乳房胀痛
D. 小腿隐痛喜按
E. 脉弦数

正确答案：D。小腿隐痛喜按

解析：小腹隐痛喜按为虚症表现，而月经后期气滞血瘀证为实证（D错，为本题正确答案）。月经后期气滞证抑郁伤肝，疏泄不及，气机不畅，血为气滞，胞宫、血海不能按时充溢故经行后期，经量减少，或有血块（AB对）。肝郁气滞，经脉壅阻，故小腹、胸胁、乳房胀痛（C对）。脉弦为气滞之征，若肝郁化热则舌质红，苔微黄，脉弦数（E对）。